经产妇，妊娠35周，今晨出现无原因，无痛性阴道流血。本例应注意的并发症是
A. 新生儿颅内出血
B. 产后宫缩乏力性出血
C. 胎盘滞留
D. 胎盘早期剥离
E. 胎儿窘迫

正确答案：B。产后宫缩乏力性出血

解析：经产妇（多孕产次为前置胎盘的好发人群），妊娠35周(妊娠晚期），出现无原因，无痛性阴道流血（前置胎盘的典型症状为无诱因、无痛性反复阴道流血）。综合该患者的病史、临床表现，该患者首先考虑的诊断是前置胎盘。前置胎盘的并发症有产时出血、产后宫缩乏力性出血（B对）、植入性胎盘、产褥感染、围产儿预后不良。新生儿颅内出血（A错）是常见的一种脑损伤，系由产伤和缺氧引起。胎盘滞留（C错）指胎儿娩出后30分钟，胎盘尚未娩出者。胎盘早期剥离（D错）指妊娠20周后或分娩期，正常位置的胎盘在胎儿娩出前，部分或全部从子宫壁剥离。胎儿窘迫（E错）由胎儿在子宫内因急性或慢性缺氧引起。